牙槽突裂的治疗以下哪项为主
A. 唇裂整复术
B. 腭裂整复术
C. 牙槽突裂修复术
D. 正畸治疗
E. 固定义齿修复

正确答案：C。牙槽突裂修复术

解析：本题考查牙槽突裂的治疗。牙槽突裂的治疗应以手术治疗为主，即牙槽突裂修复术（C对），包括软组织裂隙或瘘口关闭和骨组织移植两部分。唇裂修复术（A错）用于唇裂的治疗。腭裂整复术（B错）用于腭裂的治疗。正畸治疗（D错）用于错（牙合）畸形的治疗。固定义齿修复（E错）用于牙列缺损的修复治疗。